蜘蛛痣的常见部位是
A. 上胸部
B. 上腹部
C. 足部
D. 臀部
E. 大腿

正确答案：A。上胸部

解析：蜘蛛痣为皮肤小动脉末端分支性扩张所形成的血管痣，形似蜘蛛，多出现于上腔静脉分布的区域内，如面、颈、手背、上臂、上胸（A对）和肩部等处，其大小不等。一般认为蜘蛛痣的出现与肝脏对雌激素的灭活作用减弱有关，常见于急慢性肝炎或肝硬化。